下列关于甲状腺激素的作用，哪项错误
A. 增加组织耗氧量，促进产热
B. 促进婴幼儿脑和骨的发育
C. 引起黏液水肿
D. 增加糖原分解和糖异生
E. 提高神经系统的兴奋性

正确答案：C。引起黏液水肿